属于刺激性泻药，长期使用可引起结肠黑变病的药物是
A. 番泻叶
B. 利那洛肽
C. 莫沙必利
D. 乳果糖
E. 聚乙二醇4000

正确答案：A。番泻叶

解析：本题考查常用缓泻药。中药类泻药如芦荟胶囊、六味安消、三黄片、番泻叶（A对）等，长期服用可引起结肠黑变病。